男婴，8个月。腹泻3天，大便10余次/日，蛋花汤样伴少量黏液，呕吐，4～5次/日。嗜睡，口干，严重少尿或无尿。体检：粘膜非常干燥，弹性降低，眼窝及前囟明显凹陷，哭时无泪。血钠132mmol/L，血钾4mmol/L。该患儿诊断为婴儿腹泻合并
A. 轻度等渗脱水
B. 中度等渗脱水
C. 重度等渗脱水
D. 中度高渗脱水
E. 重度高渗脱水

正确答案：C。重度等渗脱水

解析：患儿嗜睡，粘膜非常干燥弹性降低，眼窝及前囟明显凹陷（提示重度），哭时无泪，严重少尿或无尿，应考虑重度脱水。患儿血钠132mmol/L，应诊断为等渗性脱水（C对）。